下列各项，属阳中之阳的是
A. 肺
B. 肾
C. 肝
D. 心
E. 脾

正确答案：D。心

解析：本题考查脏腑的阴阳属性，属于理解记忆内容。心肺居于上属阳，而心属火，主温通，为阳中之阳（D对）；肺属金，主肃降，为阳中之阴（A错）。肝、脾、肾居下属阴，而肝属木，主升发，为阴中之阳（C错）；肾属水，主闭藏，为阴中之阴（B错）；脾属土，居中焦，为阴中之至阴（E错）。